胰头癌最常见的病理类型是
A. 导管细胞腺癌
B. 乳头状癌
C. 腺泡细胞癌
D. 未分化癌
E. 黏液腺癌

正确答案：A。导管细胞腺癌

解析：胰头癌的病理类型有导管细胞腺癌、腺泡细胞癌、黏液腺癌、未分化癌、囊腺癌、实性癌等，其中最常见的是导管细胞腺癌（A对CDE错），约占全部胰腺癌的90%。一般无乳头状癌（B错）。